其对映异构体产生相同的药理活性，但强弱不同的药物是
A. 丙氧酚
B. 依托唑啉
C. 异丙嗪
D. L-甲基多巴
E. 氯苯那敏

正确答案：E。氯苯那敏

解析：本题考查药物的手性特征及其对药物作用的影响。氯苯那敏（E对）的对映异构体产生相同的药理活性，但强弱不同。氯苯那敏分子中的手性碳原子离芳环近，产生空间选择性，因此右旋体活性高于左旋体。丙氧酚（A错）的对映异构体之间产生不同的药理活性，右丙氧酚是镇痛药，左丙氧酚是镇咳药，这两种对映体在临床上用于不同的目的，作用于不同的靶器官。依托唑啉（B错）的对映异构体产生相反活性。左旋体为利尿药，右旋体则有抗利尿作用，因为这类药物的对映体与受体均有一定的亲和力，但通常只有一种对映体具有活性，另一对映体反而起拮抗剂的作用。异丙嗪（C错）的对映异构体之间活性强度相同，均为抗组胺药。抗高血压药物L-甲基多巴（D错）仅L-构型的化合物有效，其对映异构体没有活性，产生这种构型与活性差异的原因部分是来自受体对药物的空间结构要求比较严格。